主要使去甲肾上腺素灭活的酶
A. 单胺氧化酶
B. 胆碱酯酶
C. 甲状腺过氧化物酶
D. 黏肽代谢酶
E. 血管紧张素转化酶

正确答案：A。单胺氧化酶

解析：本题考查单胺氧化酶抑制剂。主要使去甲肾上腺素灭活的酶是单胺氧化酶（A对）。去甲肾上腺素主要在肝内代谢，一部分在各组织内，依靠儿茶酚氧位甲基转换酶（COMT）和单胺氧化酶作用，转为无活性的代谢产物。经肾排泄，绝大部分为代谢产物，仅微量以原形排泄。